根据骨度分寸，悬钟穴距外踝尖的距离是
A. 2寸
B. 3寸
C. 4寸
D. 5寸
E. 7寸

正确答案：B。3寸

解析：根据骨度分寸，下肢腘横纹到外踝尖为16寸。悬钟在小腿外侧，外踝尖上3寸（B对）。主治痴呆、中风等髓海不足疾患；颈项僵痛，胸胁满痛，下肢痿痹。宜直刺0.5-0.8寸。